不属于车前草中车前性状特征的是
A. 主根直而长
B. 叶呈卵状椭圆形或宽卵形，具明显弧形脉5～7条
C. 穗状花序数条
D. 蒴果椭圆形，盖裂
E. 气微香，味微苦

正确答案：A。主根直而长